属于哌啶酮类镇静催眠药的是
A. 异戊巴比妥
B. 阿米替林
C. 格鲁米特
D. 氯硝西泮
E. 甲丙氨酯

正确答案：C。格鲁米特